口腔癌致病因素中不属于不良生活习惯的是
A. 嚼槟榔
B. 营养缺乏
C. 吸烟
D. 嚼烟草
E. 饮酒

正确答案：B。营养缺乏

解析：本题考查口腔癌的危险因素。口腔癌致病因素中不属于不良生活习惯的是营养缺乏（B错，为本题正确答案）。口腔癌的危险因素：(一)不良生活方式：1.吸烟（C对）、嚼烟草（D对）；2.咀嚼槟榔（A对）；3.饮酒（E对）。（二）环境因素：1.光辐射；2.核辐射；3.环境污染。（三）生物因素：1.感染；2.慢性刺激与损伤。（四）其他：口腔癌的致病因素是复杂的、综合的，它还与营养不良、缺乏运动、遗传、年龄、种族、药物等有关系。